水痘发热后几日开始出皮疹
A. 半天
B. 1天
C. 2天
D. 3天
E. 5天

正确答案：B。1天

解析：水痘发热后1天（B对）开始出皮疹。常见的出疹性疾病的出疹时间是考试中经常碰到的题目，我们可以总结成顺口溜来记忆：水痘风疹首日现，猩红次日麻疹三，斑疹伤寒多第五，伤寒一周少一天（或风水红花莫悲伤——风疹、水痘、猩红热、天花、麻疹、斑疹伤寒、伤寒）。